合成纤维可能引起的人体健康问题与下列哪项无关
A. 膀胱炎
B. 尿道炎
C. 皮肤炎
D. 过敏性哮喘
E. 膀胱癌

正确答案：E。膀胱癌

解析：本题考查合成纤维可能引起的人体健康问题。合成纤维对人体健康的影响有：1.合成纤维不吸汗，化纤内衣透气性差，容易使细菌生长繁殖，引发尿道炎（B对）和膀胱炎（A对）；2.由尼龙、腈纶、丙纶、氯纶和维尼纶等面料做成的贴身内衣，会引起接触性皮炎（C对）及接触性荨麻疹，并引发过敏性哮喘（D对）；3.化纤衣服静电感应严重，静电干扰可改变体表电位差，使心脏电传导改变，引起心律失常。合成纤维与膀胱癌（E错，为本题正确答案）无关。